下列关于病、证、症的说法，不正确的是
A. 疾病反映的是一种疾病全过程的总体属性、特征和规律
B. 证反映的是疾病某一阶段或某一类型的病理性质
C. 证具有时相性特征，也具有空间特征
D. 症状和体征是构成病和证的基本要素
E. 症可以反应疾病或症候的本质特征

正确答案：E。症可以反应疾病或症候的本质特征

解析：证是病机的概括，病机是证的内在本质，证所反映的是疾病的本质（E错，为本题正确答案）。疾病反映的是贯穿一种疾病全过程的总体属性、特征和规律（A对）。证，是对疾病过程中一定阶段的病因、病位、病性、病势等病机本质的概括（B对）；证具有个体差异性、时相性、空间性和动态性特征（C对）。症状和体征是认识病和证的着眼点，是病和证的基本构成要素（D对）。